对于阻生牙拔除与否的处理，不正确的一项是
A. 反复引起冠周炎者应予拔除
B. 造成邻牙牙根吸收者应予拔除
C. 引起邻牙远中面龋坏者应予拔除
D. 牙冠表面有龈瓣覆盖者应予拔除
E. 可能为颞下颌关节紊乱病的病因应予拔除

正确答案：D。牙冠表面有龈瓣覆盖者应予拔除

解析：下颌阻生第三磨牙拔除术的适应证：反复引起冠周炎症者；本身有龋坏，或引起第二磨牙牙体、牙周病变者；因正畸需要时；可能为颞下颌关节紊乱病诱因者；因完全骨阻生而被疑为原因不明的神经痛病因者或可疑为病灶牙者；已引起牙源性囊肿或肿瘤；因压迫导致第二磨牙牙根中远中骨吸收；引起第二磨牙与第三磨牙直接食物嵌塞。掌握“阻生牙拔除术”知识点。